关于颌面部先天梅毒的相关叙述中，不恰当的是
A. 婴儿常为早产儿
B. 晚期先天梅毒可表现硬腭穿孔、鼻中隔穿孔
C. 哈钦森牙
D. 桑葚状磨牙
E. 很少累及鼻黏膜受累

正确答案：E。很少累及鼻黏膜受累

解析：本题考查颌面部梅毒。先天梅毒：婴儿常为早产儿（A对），表现营养障碍，貌似老人。鼻黏膜受累（E错，为本题正确答案），致鼻腔变窄，呼吸不畅，有带血的脓性黏液分泌。晚期先天梅毒多发生在儿童及青春期。除有早期先天梅毒的遗留特征外，一般与后天三期梅毒相似。可发生结节型梅毒疹及树胶样肿，从而导致软硬腭穿孔、鼻中隔穿孔及鞍状鼻（B对）。先天梅毒的另一特征性表现是哈钦森牙（C对）和桑葚状磨牙（D对）。